含有硝基乙烯二胺结构片断的抗溃疡药物是
A. 法莫替丁
B. 奥美拉唑
C. 西咪替丁
D. 雷尼替丁
E. 尼扎替丁

正确答案：D。雷尼替丁